对于肥胖患者应控制总能量的摄入，目前推荐的膳食构成为蛋白质、脂肪和碳水化合物的供能比分别为
A. 20%、＜20%和50%～60%
B. 15%、＜30%和50%～55%
C. 20%、＜30%和40%～50%
D. 10%、＜30%和50%～60%
E. 15%、＜20%和50%～65%

正确答案：B。15%、＜30%和50%～55%